肿疡已成，毒盛正气不虚尚未溃破或溃而脓出不畅者，治疗应首选
A. 消法
B. 补托法
C. 清热法
D. 透托法
E. 温通法

正确答案：D。透托法

解析：透托法用于肿疡已成，毒盛正气不虚，肿疡尚未溃破或溃破后脓出不畅，多用于实证，方如透脓散（D对）。消法适用于尚未成脓的初期肿疡和非化脓性肿块性疾病以及各种皮肤疾病（A错）。补托法在正实毒盛的情况下不可施用，否则不但无益。反能滋长毒邪，使病势加剧而犯“实实之戒”（B错）。由于外科疮疡多因火毒所生，所以清热法是外科的主要治疗法则（C错）。温通法中温经通阳、散寒化痰法适用于体虚寒痰阻于筋骨。温经通阳、散寒化痰法适用于体虚寒痰阻于筋骨（E错）。